初级卫生保健的基本任务是
A. 促进健康、医疗保障、预防保健、社区康复
B. 促进健康、社会病防治、计划生育、社区康复
C. 促进健康、预防保健、合理医疗、社区康复
D. 促进健康、合理用药、计划生育、社区康复
E. 以上都不是

正确答案：C。促进健康、预防保健、合理医疗、社区康复

解析：本题考查初级卫生保健的基本任务。初级卫生保健是指普及适宜的、技术可靠、社会能接受和负担的技术，使全体人民公平地获得基本卫生服务。其基本任务是：1.促进健康：加强自我保健，增强体质和心理健康；2.预防：在发病前期采取措施，防止疾病的发生；3.治疗：在发病初期采取措施，防止疾病继续发展，早期发现、早期诊断、及时治疗；4.康复：病人症状和体征已经出现，防止并发症和残疾，防止病残，加强康复（C对ABDE错）。